颗粒的流动性较差时，易发生
A. 裂片（顶裂）
B. 松片
C. 黏冲
D. 片重差异超限
E. 崩解迟缓

正确答案：D。片重差异超限

解析：本题考查片剂制备中的常见问题及原因。颗粒的流动性较差时，易发生片重差异超限（D对）。片重差异超限即片剂的重量超出药典规定的片重差异允许范围。产生的原因有：①物料流动性不好；②物料中的细粉太多或粒度大小相差悬殊；③料斗内的物料时多时少；④刮粉器与模孔的吻合性差等。裂片（顶裂）（A错）产生的原因为物料中细粉太多及物料塑形差，结合力弱等。松片（B错）产生的原因主要有黏合力差，压缩压力不足等。黏冲（C错）产生的原因为颗粒不够干燥、物料较易吸湿、润滑剂选用不当或用量不足、冲头表面锈蚀、粗糙不光或刻字等。崩解迟缓（E错）产生的原因主要为片剂的压力过大，导致内部空隙小，影响水分渗入；可溶性成分溶解，堵住毛细孔，影响水分的渗入；增塑性物料或黏合剂使片剂的结合力过强；崩解剂性能较差等。